下列辅料中，可生物降解的合成高分子囊材是
A. CMC-Na
B. HPMC
C. EC
D. PLA
E. CAP

正确答案：D。PLA

解析：本题考查药物微囊化的材料。聚酯类是应用最广的可生物降解的合成高分子，如聚碳酯、聚氨基酸、聚乳酸 （PLA）（D对）、丙交酯乙交酯共聚物（PLGA）、聚乳酸-聚乙二醇嵌段共聚物等。其中，PLA和PLGA是被FDA批准的可降解材料，而且已有产品上市。CMC-Na（羧甲基纤维素钠）（A错）、HPMC（羟丙甲纤维素）（B错）、EC（乙基纤维素）（C错）、CAP（醋酸纤维素酞酸酯）（E错）均为半合成高分子囊材。